丘脑的非特异性投射系统的主要作用是
A. 维持大脑皮质的兴奋状态
B. 引起温度觉
C. 引起触觉
D. 使机体进入睡眠状态
E. 引起痛觉

正确答案：A。维持大脑皮质的兴奋状态